抑制髓袢升支粗段的Na⁺-K⁺-2Cl⁻偶联转运系统的药物
A. 呋喃苯胺酸
B. 乙酰唑胺
C. 安体舒通
D. 氨苯蝶啶
E. 甘露醇

正确答案：A。呋喃苯胺酸

解析：本题考查利尿药的作用机制。抑制髓袢升支粗段的Na⁺-K⁺-2Cl⁻偶联转运系统的药物是呋喃苯胺酸（A对）。呋喃苯胺酸又名呋塞米，为高效利尿药，主要作用部位在髓袢升支粗段，干扰Na⁺-K⁺-2Cl⁻共同转运系统，产生强大的利尿作用。乙酰唑胺（B错）是碳酸酐酶抑制剂。安体舒通（C错）又名螺内酯，为醛固酮受体阻断剂。氨苯蝶啶（D错）为保钾利尿药。甘露醇（E错）为渗透性利尿药。